除另有规定外，分散片应检查
A. 溶出度
B. 发泡量
C. 释放度
D. 融变时限
E. 溶散时限

正确答案：A。溶出度

解析：本题考查的是片剂的溶出度。除另有规定外，分散片应检查溶出度（A对）。片剂的溶出度：分散片、以难溶性原料药物制成的口崩片应进行溶出度检查，并符合各品种项下的规定。发泡量（B错）为片剂的检查项目。阴道泡腾片应检查发泡量。释放度（C错）为肠溶制剂、缓释制剂、控释制剂的检查项目。肠溶制剂、缓释制剂与控释制剂应进行释放度检查，并符合各品种项下的规定。融变时限（D错）为阴道片与栓剂的检查项目。阴道片的融变时限：阴道片应检查融变时限。除另有规定外，阴道片3片，均应在30分钟内全部溶化或崩解溶散并通过开孔金属圆盘，或仅残留少量无硬心的软性团块。栓剂的融变时限：融变时限，除另有规定外，脂肪性基质的栓剂应在30分钟内全部融化、软化或触压时无硬芯，水溶性基质的栓剂应在60分钟内全部溶解。重量差异应符合规定，凡规定检查含量均匀度的栓剂，可不进行重量差异检查。栓剂的微生物限度照《中国药典》规定的检查方法检查，应符合规定。溶散时限（E错）为丸剂的检查项目。丸剂的溶散时限：除另有规定外，小蜜丸、水蜜丸和水丸应在1小时内全部溶散；浓缩丸和糊丸应在2小时内全部溶散；滴丸应在30分钟内全部溶散，包衣滴丸应在1小时内全部溶散。蜡丸照崩解时限检查法片剂项下的肠溶衣片检查法检查，在盐酸溶液中（9→1000）检查2小时，不得有裂缝、崩解或软化现象，再在磷酸盐缓冲液（pH6.8）中检查，1小时内应全部崩解。除另有规定外，大蜜丸及研碎、嚼碎后或用开水、黄酒等分散后服用的丸剂不检查溶散时限。